澄清度检查法是检查
A. 不溶性杂质
B. 遇硫酸易炭化的杂质
C. 水分及其他挥发性物质
D. 有色杂质
E. 硫酸盐杂质

正确答案：A。不溶性杂质